男，70岁。乏力、腰痛半个月。既往体健。查体：轻度贫血貌，第2～4腰部压痛。实验室检查：Hb50g／L，WBC5.6x109／L，Plt156x109／L。血清总蛋白108g／L，白蛋白30g／L，血肌酐187umol／L。骨髓细胞学检查示骨髓中异常浆细胞占0.45。腰椎X线片示第2腰椎压缩性骨折。为进一步明确诊断，下一步最需要做的检查是
A. 血清β2微球蛋白测定
B. 尿本-周蛋白测定
C. 尿常规
D. 血清钙测定
E. 血、尿免疫球蛋白测定

正确答案：E。血、尿免疫球蛋白测定

解析：需满足第1条及第2条，加上第三条中任何一项。1. 骨髓单克隆浆细胞比例≥10% 和（或）组织活检证明有浆细胞瘤2.血清和（或）尿出现单克隆M蛋白（E对）3.骨髓瘤引起的相关表现